下述关于硬腭软组织特点的叙述中哪项是错误的
A. 硬腭前部粘膜下层无腺体，含有少量脂肪
B. 腭腺肿瘤多发生在硬腭后部
C. 粘骨膜在腭中线处较厚，而在近牙槽骨部较薄
D. 在作腭两侧松弛切口时，应尽量靠近牙龈切，以免损伤腭部主要神经血管
E. 粘骨膜易于从骨面分离

正确答案：C。粘骨膜在腭中线处较厚，而在近牙槽骨部较薄

解析：粘骨膜在腭中线处较薄，而在两侧近牙槽骨部分却显著增厚，这是由于在近牙槽骨部分含有腭腺及神经和血管的原因。掌握“腭、舌、舌下区的局部解剖”知识点。